《医疗机构制剂配制质量管理规范（试行）》规定，医疗机构制剂是指医疗机构根据本单位
A. 科研需要而配制、自用的固定处方制剂
B. 临床需要而常规配制、自用的固定处方制剂
C. 临床与科研需要，而配制的固定处方制剂
D. 临床需要，由医师和药师共同研制的制剂
E. 临床特殊病例需要，由医生提供的特殊处方制剂

正确答案：B。临床需要而常规配制、自用的固定处方制剂

解析：本题考查医疗机构制剂。《医疗机构制剂配制质量管理规范（试行）》规定，医疗机构制剂是指医疗机构根据本单位临床需要而常规配制、自用的固定处方制剂（B对）。